在连续对某水体含氮化合物指标进行监测时发现，氨氨、亚硝酸盐氮、硝酸盐氮含量在不同时段变化不一。监测末期时，水体中仅硝酸盐氮升高，大致可判断水体的污染状况为
A. 持续污染
B. 过去曾被污染，现已停止
C. 过去曾被污染，现仍继续
D. 新近污染，自净尚未开始
E. 新近污染，自净已在进行，

正确答案：B。过去曾被污染，现已停止

解析：本题考查水体的污染状况。硝酸盐氮是含氮有机物氧化分解的最终产物。水体中仅硝酸盐氮升高，大致可判断水体的污染状况为过去曾被污染，现已停止（B对ACDE错）。